女，35岁。近5年来间断头痛，每月发作1～2次，MRI示左顶枕脑内蜂窝样血管流空影，呈楔形。该患者最佳治疗方案是
A. 药物栓塞
B. 手术
C. 射频消融
D. 血管内介入治疗
E. 无需处理

正确答案：D。血管内介入治疗

解析：本例患者中年女性，有间断头痛史，MRI示左顶枕脑内蜂窝样血管流空影，呈楔形，诊断为脑动静脉畸形。脑动静脉畸形的治疗目的是防止出血，减轻或纠正“脑盗血”，改善脑组织血供，缓解神经功能障碍，控制癫痫，提高患者生活。目前的治疗方法包括保守治疗、显微手术切除术、血管内介入治疗和立体定向放射治疗。血管内介入治疗（D对）创伤小，安全性高，可以在检查的同时进行治疗，是最佳治疗方案。药物栓塞（A错）属于保守治疗，只用于老年人及不能行介入或手术的患者。手术（B错）创伤较大，技术要求高，不是最佳方案。射频消融（C错）不能解决动静脉血管畸形的问题。患者有明显的脑动静脉畸形，并有间断头痛症状，无需处理（E错）明显不当。